女性，22岁，因右下智齿低位埋伏阻生，要求拔除。在注射局麻药后牙关紧闭，可能是发生了
A. 感染
B. 水肿
C. 血肿
D. 气肿
E. 翼内肌暂时性痉挛

正确答案：E。翼内肌暂时性痉挛

解析：本题考查局麻并发症-牙关紧闭。牙关紧闭为局麻并发症之一。下齿槽神经阻滞麻醉后牙关紧闭，可能是注射不准确，麻药注入翼内肌，使肌肉暂时失去收缩与舒张的功能，并停滞于收缩状态，即翼内肌暂时性痉挛（E对）。感染（A错）也是局麻并发症之一，由于注射针被污染，局部或麻药消毒不严，或注射针穿过感染灶，均可将感染带入深层组织，引起颞下间隙、翼下颌间隙、咽旁间隙等感染，引起张口度变小，不会引起牙关紧闭。水肿（B错）见于拔牙时手术创伤引起的术后并发症。血肿（C错）也是局麻并发症，由于注射针刺破血管所致，较常见于上牙槽后神经、眶下神经阻滞麻醉，特别是刺伤静脉丛后，可发生组织内出血。气肿（D错）是由气枪的气体或双氧水冲洗时氧气进入组织间隙引起的。